重金属检查法中，所使用的醋酸盐缓冲液的pH值是
A. 1.5
B. 2.5
C. 3.5
D. 4.5
E. 5.5

正确答案：C。3.5

解析：本题考查重金属检查法。重金属检查法中，所使用的醋酸盐缓冲液的pH值是3.5（C对）。